按龋坏程度可将龋病分为
A. 急性龋、慢性龋、静止性龋
B. 浅龋、中龋、深龋
C. 窝沟龋、平滑面龋
D. 牙釉质龋、牙本质龋和牙骨质龋
E. 干性龋、湿性龋

正确答案：B。浅龋、中龋、深龋

解析：本题考查龋病的分类。按龋坏程度可将龋病分为浅龋、中龋、深龋（B对）。按发病情况和进展速度可将龋病分为急性龋（湿性龋）、慢性龋（干性龋）、静止性龋（AE错）、继发龋。根据牙面解剖形态和分为窝沟龋和平滑面龋（C错）。牙釉质龋、牙本质龋和牙骨质龋是龋病的组织学分类（D错）。